外膜为浆膜的是
A. 咽
B. 食管
C. 直肠下部
D. 胃
E. 以上均不是

正确答案：D。胃

解析：胃(D对)为腹膜内位器官，其外膜为浆膜。